毒性极强的生物碱是
A. 羟基苦参碱
B. 伪麻黄碱
C. 巴马丁
D. 表小檗碱
E. 士的宁

正确答案：E。士的宁

解析：本题考查的是马钱子在临床应用中应注意的问题。毒性极强的生物碱是士的宁（E对）。马钱子成熟种子中生物碱含量为1.5%～5%，主要生物碱是士的宁（又称番木鳖碱）、马钱子碱及其氮氧化物，还含少量的10余种其他吲哚类生物碱，其中以士的宁含量居首，占总碱量的35%～50%，其次是马钱子碱，占总碱量的30%～40%。《中国药典》以士的宁和马钱子碱为指标成分进行含量测定，要求士的宁的含量应为1.20%～2.20%，马钱子碱的含量不得少于0.80%。马钱子含生物碱主要是士的宁和马钱子碱，前者约占总生物碱的45%，是主要的有效成分亦是有毒成分，成人用量5～10mg可发生中毒现象，30mg可致死。羟基苦参碱（A错）为苦参的主要化学成分。苦参中主要生物碱及其化学结构：苦参所含主要生物碱是苦参碱和氧化苦参碱，《中国药典》以其为指标成分进行鉴别和含量测定，含量测定要求苦参碱和氧化苦参碱总量不得少于1.2%。此外还含有羟基苦参碱、N-甲基金雀花碱、安那吉碱、巴普叶碱和去氢苦参碱（苦参烯碱）等。这些生物碱都属于双稠哌啶类。伪麻黄碱（B错）为麻黄的主要化学成分。麻黄中含有多种生物碱，以麻黄碱和伪麻黄碱为主，前者占总生物碱的40%～90%，《中国药典》以盐酸麻黄碱和盐酸伪麻黄碱为指标成分进行含量测定，要求药材和饮片含盐酸麻黄碱和盐酸伪麻黄碱的总量不得少于0.80%。此外麻黄还含少量的甲基麻黄碱、甲基伪麻黄碱和去甲基麻黄碱、去甲基伪麻黄碱。麻黄生物碱具兴奋中枢神经系统及强心、升高血压的作用，因此用量过大（治疗量的5～10倍）或急性中毒者，可引起头痛，烦躁，失眠，心悸，大汗不止，体温及血压升高，心动过速，心律失常，呕吐，甚至昏迷、惊厥、呼吸及排尿困难，心室纤颤等症状，甚至心肌梗死或死亡。巴马丁（C错）与表小檗碱（D错）为黄连的主要化学成分。黄连的有效成分主要是生物碱，已经分离出来的生物碱有小檗碱（含量最高）、巴马汀、黄连碱、甲基黄连碱、药根碱和木兰碱（属于阿朴菲型）等；大多属苄基异喹啉类衍生物，季铵型生物碱。《中国药典》以小檗碱为指标成分进行含量测定。以盐酸小檗碱计，要求味连含小檗碱不得少于5.5%，表小檗碱不得少于0.80%，黄连碱不得少于1.6%，巴马汀不得少于1.5%；要求雅连含小檗碱不得少于4.5%；要求云连含小檗碱不得少于7.0%。